下列哪项能够用来说明某种现象发生的频率或强度
A. 率
B. 构成比
C. 平均数
D. 标准差
E. 标准误

正确答案：A。率

解析：率：是用来说明某种现象发生的频率或强度。在评价口腔疾病的患病状况时，常用率来表示人群中疾病状况的高低。掌握“口腔健康状况调查数据的整理和统计”知识点。